从乳浊液中除去分散相挥发性溶剂以制备微囊的方法
A. 单凝聚法
B. 复凝聚法
C. 溶剂-非溶剂法
D. 改变温度法
E. 液中干燥法

正确答案：E。液中干燥法